不属于第二代抗精神病药的是
A. 奎地平
B. 利培酮
C. 奥氮平
D. 氯氮平
E. 舒必利

正确答案：E。舒必利

解析：抗精神病药分为典型的或安定类的抗精神病药物（既第一代抗精神病药）及非典型抗精神病病药（既第二代抗精神病药）。第一代抗精神病药物主要包括以氯丙嗪为代表的吩噻嗪类，以氯普噻吨为代表的硫杂蒽类，以及以氯哌啶醇为代表的丁酰苯类等。第二代抗精神病药物由于锥体外系作用不明显，因而被认为是“非典型的”，其中的代表药物是氯氮平、奥氯平、喹硫平（别名：奎地平）和低剂量的利培酮等（ABCD对）。舒必利（E错，为本题正确答案）属于苯甲酰胺类，虽为非典型抗精神病药，但大部分人将其归为第一代抗精神病药物。